荆芥生用不具有的功效是
A. 散风
B. 发表
C. 止血
D. 透疹
E. 止痒

正确答案：C。止血

解析：本题考查的是荆芥的性能特点。荆芥生用不具有的功效是止血（C错，为本题正确答案）。荆芥：【性能特点】本品生用辛微温发散，入肺、肝经。既善散肌表与血分风邪而解表（B对）、透疹（D对）、止痒（E对）、疗疮，又兼散息内风而止痉。力平和，散风（A对）发表通用，风寒、风热皆宜。炒炭微温涩敛，入肝经血分，收敛止血，治崩漏功良。